与克山病有关的营养素是
A. 维生素A
B. 铬
C. 硒
D. 维生素PP
E. 碘

正确答案：C。硒